男，57岁。胸痛、吞咽困难2周。既往反酸、烧心10余年，口服抑酸剂可缓解，为明确诊断首选的检查是
A. 胸部X线片
B. 胃镜
C. 腹部B超
D. 上消化道X线钡餐造影
E. 胸部CT

正确答案：B。胃镜

解析：中老年男性患者，既往有10余年反酸、烧心病史，口服抑酸剂可缓解（胃食管反流病的典型症状）。2周来胸痛、吞咽困难（食管癌的典型症状），提示胃食管反流病进展为食管癌的可能，为明确诊断，首选的检查是胃镜（B对）。胃镜可直接观察病灶的形态，并可在直视下做活检，以确定诊断。胸部X线片（A错）主要显示肺部和纵隔的转移情况，帮助判断肿瘤的分期，在确诊食管癌方面价值不大。腹部B超（C错）容易受到消化道内气体干扰，不用于诊断消化系统疾病。上消化道X线钡餐造影（D错）可显示食道黏膜病变、溃疡（呈龛影）及隆起的病灶（呈充盈缺损），作为食管癌诊断的次选方法。胸部CT（E错）可清晰显示食管与邻近纵隔的关系，难以发现早期食管癌。